血管神经性水肿可能出现的严重的并发症是
A. 哮喘
B. 眼睑肿胀
C. 食道狭窄
D. 舌活动受限
E. 喉头水肿、窒息

正确答案：E。喉头水肿、窒息

解析：本题考查血管神经性水肿可能出现的严重并发症。血管神经性水肿是一种急性局部超敏反应性的黏膜皮肤水肿，表现为突然发作局限性水肿，但消退亦较快。发生于会厌处则引发喉头水肿、窒息（E对），如不立即行气管切开，可导致死亡。血管神经性水肿一般不会引发哮喘（A错）。发生在眼睑部表现为眼睑肿胀（B错），但数小时或数天后可自行消退。亦可引起食道狭窄（C错）、舌活动受限（D错），但肿胀消退后即可解除，不会危及生命。